女孩，2岁。体检发现胸骨左缘第2～3肋间Ⅱ～Ⅲ级收缩期杂音，肺动脉瓣区第2音亢进，伴固定性分裂。该患儿的诊断是
A. 动脉导管未闭
B. 房间隔缺损
C. 室间隔缺损
D. 法洛四联症
E. 肺动脉瓣狭窄

正确答案：B。房间隔缺损

解析：固定性分裂仅见于房间隔缺损，另外房间隔缺损也可出现胸骨左缘第2-3肋间Ⅱ—Ⅲ级收缩期杂音，因此该患儿诊断为房间隔缺损（B对）。动脉导管未闭的杂音特征为胸骨左缘第二肋间连续机械样杂音（A错）。室间隔缺损的杂音特征胸骨左缘3-4肋间Ⅲ级收缩期杂音，肺动脉第二音亢进（C错）。法洛四联症的杂音主要源自于其组成之一肺动脉狭窄，杂音特点是胸骨左缘Ⅱ、Ⅲ、Ⅳ肋间收缩期喷射性杂音，不符合所给病例的杂音特点，所以不能诊断为法洛四联症（D错）。肺动脉狭窄胸骨左缘上部有洪亮的Ⅳ/Ⅵ级以上喷射性收缩期杂音，第二心音分裂（而不是肺动脉第二心音亢进）（E错）。